造成垂直型食物嵌塞的主要原因是
A. 牙周萎缩
B. 牙齿松动
C. 过度磨损
D. 接触点消失或异常
E. 不良修复体

正确答案：D。接触点消失或异常

解析：本题考查垂直型食物嵌塞的原因。造成垂直型食物嵌塞的主要原因是接触点消失或异常（D对）。牙龈乳头萎缩多造成水平型食物嵌塞，相邻牙接触关系不良或失去接触则是垂直型食物嵌塞的常见原因。1.垂直性嵌塞的可能原因：（1）两邻牙之间失去正常的接触关系，出现缝隙，则食物易嵌入。这种情况发生于：①邻面龋破坏了接触区和边缘嵴；②充填物或全冠等修复体未恢复接触区；③牙齿的错位或扭转等，使接触区的大小和位置异常；④缺失牙未及时修复，邻牙向缺牙间隙倾倒，使相邻牙之间失去接触；⑤患牙周病的牙过于松动，接触不佳。（2）来自对（牙合）牙的楔力或异常的力。多是由于多种原因造成的牙齿的形态异常，如有过度尖锐的牙尖将食物楔入两牙之间。也可因牙齿的倾斜等原因造成食物易嵌入两牙之间。（3）由于邻面和（牙合）面的磨损而使食物外溢道消失，致使食物被挤入牙间隙。2.水平性嵌塞的可能原因：如果两牙之间的牙龈乳头退缩等原因造成两牙之间下方出现空隙，食物易在唇、颊及舌部的力量下水平进入此间隙，造成水平性食物嵌塞。